河豚毒素的作用机制是
A. 刺激胃肠黏膜、引起恶心、呕吐
B. 作用于腺苷酸环化酶、产生腹泻
C. 阻断神经冲动传导，使经麻痹
D. 刺激迷走神经，通过呕吐中枢，引起呕吐
E. 作用于外周神经肌肉接头处

正确答案：C。阻断神经冲动传导，使经麻痹